下列溶液中，用于紫外-可见分光光度计吸光度准确度检定的是
A. 磷酸盐缓冲溶液
B. 氢氧化钠溶液
C. 盐酸溶液
D. 氯化钠溶液
E. 重铬酸钾的硫酸溶液

正确答案：E。重铬酸钾的硫酸溶液

解析：本题考查紫外-可见分光光度法的仪器校正和检定。吸光度的准确度可用重铬酸钾的硫酸溶液（E对）检定。取在120℃干燥至恒重的基准重铬酸钾约60mg，精密称定，用0.005mol/L硫酸溶液溶解并稀释至1000ml，在规定的波长处测定并计算其吸收系数，并与规定的吸收系数比较，应符合规定。